患者，男，65岁。既往无心脏病史，体检发现胸骨右缘2～3肋间3级收缩期杂音，粗糙吹风样，A₂减弱，余无异常。诊断多为
A. 风心病主动脉瓣狭窄
B. 先心病主动脉瓣狭窄
C. 主动脉瓣下狭窄
D. 老年性主动脉瓣退行性改变
E. 主动脉硬化

正确答案：D。老年性主动脉瓣退行性改变

解析：本例老年男性患者，既往无心脏病史，体检发现主动脉瓣第2听诊区3级收缩期粗糙吹风样杂音，伴A₂减弱，提示主动脉瓣活动受限，诊断多为老年性主动脉瓣退行性改变（D对）。风心病（A错）、高血压病（B错）造成的主动脉瓣狭窄，是在心脏有器质性心脏病的基础上发生的。主动脉瓣下狭窄（C错）通常无症状，心脏听诊不伴有喀喇音，随着年龄增长，梗阻进行性加重，患者耐力减退。主动脉硬化（E错）大多数无特异性症状，主动脉瓣区第二心音亢进而带金属音调，并有收缩期杂音。X线检查可见主动脉结向左上方凸出，主动脉扩张与扭曲，有时可见片状或弧状的斑块内钙质沉着影。